能准确评价个体儿童发育水平的方法是
A. 年增加百分位数
B. 标准差分法
C. 等级评价法
D. 指数法
E. 曲线图法

正确答案：C。等级评价法